主因骨质疏松和膈肌牵拉引起的佝偻病体征是
A. 颅骨软化
B. 方颅
C. 郝氏沟
D. 肋骨串珠
E. 前囟大

正确答案：C。郝氏沟

解析：主因骨质疏松和膈肌牵拉引起的佝偻病体征是郝氏沟，因肋骨变软，膈肌附着处牵引形成郝氏沟（C对）。颅骨软化，主要见于6个月内的婴儿，用手压枕部或顶骨后方有压乒乓球感（A错）。顶骨与额骨双侧骨样组织增生可隆起成方颅（B错）。胸部畸形多见于1岁左右婴儿，肋骨与软骨交接处膨大成串珠状，重者可压迫肺脏（D错）。骨骼改变导致前囟大（E错）。